月经的第15～28天，称为
A. 月经期
B. 增殖期
C. 分泌期
D. 分泌晚期
E. 月经周期

正确答案：C。分泌期

解析：分泌期：月经周期第15～28日，相当于黄体期。掌握“女性生殖系统生理”知识点。